男性，70岁，腹部疼痛6天，以右下腹为重，伴呕吐，检查：急性病容右下腹饱满压痛，肌紧张，血白细胞14.5×10⁹/L，腹部透视可见少量气液平面，最可能的诊断为
A. 阑尾周围脓肿
B. 急性肠梗阻
C. 急性胰腺炎
D. 急性胆囊炎
E. 急性化脓性胆管炎

正确答案：A。阑尾周围脓肿

解析：老年男性患者，腹痛6天（慢性病程），以右下腹为重（提示病变位于右下腹），有呕吐，右下腹饱满，压痛，肌紧张（腹膜刺激症状），血白细胞14.5×10⁹/L（正常为4～10×10⁹/L，提示感染），结合患者病史、体查和辅助检查，最可能的诊断为阑尾周围脓肿（A对）。腹部透视可见少量气液平面为局限性腹膜炎引起的肠麻痹所致，正常人也可出现。急性肠梗阻（B错）主要表现为腹痛、腹胀、呕吐及停止自肛门排气排便，腹膜刺激征一般较轻，腹部X线平片可见较多扩张的肠袢和阶梯状的液平面。急性胰腺炎（P457）（C错）常发生于饱餐或和饮酒后，主要表现为腹痛、腹胀、恶心、呕吐等症状，腹痛多位于左上腹，向左肩及左腰背部放射。急性胆囊炎（P443）（D错）多见于女性，病人常有胆囊结石病史，表现为右上腹绞痛或持续性疼痛伴阵发性加剧，疼痛向右肩、肩胛和背部放射，查体可有右上腹局部压痛、反跳痛，Murphy征阳性。急性化脓性胆管炎（P445）（E错）多见于青壮年，发病急骤，进展迅速，主要表现为腹痛、寒战高热、黄疸、休克及神经中枢受抑制表现等。